患者及其近亲属不配合医疗机构进行符合诊疗规范的诊疗情形中，医疗机构及其医务人员也有过错的，其属于以下的哪种情形
A. 医疗机构不承担赔偿责任情形
B. 医疗机构承担赔偿责任情形
C. 医疗损害责任的赔偿主体
D. 推定医疗机构有过错的情形
E. 医疗机构及其医务人员权益保护

正确答案：B。医疗机构承担赔偿责任情形

解析：患者或者其近亲属不配合医疗机构进行符合诊疗规范的诊疗情形中，医疗机构及其医务人员也有过错的，应当承担相应的赔偿责任。掌握“医疗损害责任”知识点。